在残留溶剂测定法中，属第一类溶剂的有
A. 苯
B. 乙腈
C. 甲醇
D. 丙酮
E. 四氯化碳

正确答案：A、E。苯；四氯化碳